咽结合膜热的病原是
A. 柯萨奇病毒
B. 带状疱疹病毒
C. 腺病毒
D. 人类疱疹病毒6型
E. 呼吸道合胞病毒

正确答案：C。腺病毒

解析：腺病毒是咽结合膜热的病原体（C对）。柯萨奇病毒是疱疹性咽峡炎的病原体（A错）。带状疱疹病毒是水痘的病原体（B错）。幼儿急疹的病原是人类疱疹病毒6型（D错）。呼吸道合胞病毒（E错）是支气管肺炎常见的病原体。